女，70岁。反复咳嗽咳痰伴气促15年。查体：双肺呼吸音减弱。辅助检查结果中对明确诊断最有价值的是
A. 血气分析示低氧血症
B. 肺功能示FVC明显降低
C. 肺功能示FEV₁/FVC明显降低
D. 肺功能示DLco下降
E. 肺泡动脉氧分压差增大

正确答案：C。肺功能示FEV₁/FVC明显降低

解析：患者为老年女性，反复咳嗽、咳痰伴气促（为慢阻肺的典型症状），双肺呼吸音减弱，初步诊断为慢性阻塞性肺疾病（COPD）。慢性阻塞性肺疾病是以持续气流受限为特征的疾病其气流受限多呈进行性发展。肺功能检查中，在使用吸入支气管扩张剂后，第一秒用力呼气容积/用力肺活量（FEV₁/FVC）＜0.70（C对）表明存在持续气流受限。慢阻肺早期患者用力肺活量可正常（B错）。低氧血症（A错）是指血液中含氧不足，慢阻肺患者病情加重时可有血氧降低，用于判断呼衰类型，但并不是COPD的确诊方法。肺功能示DLco下降（D错）提示肺弥散功能障碍，COPD为通气功能障碍的疾病，弥散功能正常。肺泡动脉氧分压差（E错）提示换气功能，均不是慢阻肺的诊断方法。